不属于血管紧张素转换酶抑制剂（ACEI）类药物作用特点是
A. 禁用于双侧肾动脉狭窄者
B. 对肾脏有保护作用
C. 可引起反射性心率加快
D. 可防治高血压患者心肌细胞肥大
E. 能降低循环组织中的血管紧张素Ⅱ水平

正确答案：C。可引起反射性心率加快

解析：本题考查血管紧张素转换酶抑制剂（ACEI）类药物作用特点。可引起反射性心率加快（C错，为本题正确答案）不属于血管紧张素转换酶抑制剂（ACEI）类药物作用特点，引起反射性心率加快的一般是硝酸甘油类药物。血管紧张素转换酶抑制剂（ACEI）药理作用包括：抑制血管紧张素转换酶的活性，降低循环组织中的血管紧张素Ⅱ水平（E对）；改善左心室功能，可防治高血压患者心肌细胞肥大（D对）。扩张动静脉，缓解肾动脉闭塞引起的高血压。调节血脂和清除氧自由基。保护肾功能（B对）。双侧肾动脉狭窄禁用ACEI类药物（A对）。